右旋糖酐40氯化钠注射液中，氯化钠的含量测定方法是
A. 滴定分析法
B. 旋光度法
C. 紫外-可见分光光度法
D. 高效液相色谱法
E. 生物检定法

正确答案：A。滴定分析法

解析：本题考查右旋糖酐40氯化钠注射液的含量测定方法。右旋糖酐40氯化钠注射液为复方制剂，用铬酸钾指示剂法（A对）测定氯化钠，右旋糖酐40不干扰，可直接测定。旋光度法（B错）用于右旋糖酐40氯化钠注射液中右旋糖酐40的含量测定。